胫骨内侧髁下方至内踝尖的骨度分寸是
A. 13寸
B. 14寸
C. 16寸
D. 18寸
E. 19寸

正确答案：A。13寸

解析：本题考查常用骨度分寸。胫骨内侧髁下方至内踝尖为13寸（A对）。臀沟至腘横纹为14寸（B错）。腘横纹至外踝尖为16寸（C错）。耻骨联合上缘至股骨内上髁上缘为18寸（D错）。股骨大转子至腘横纹为19寸（E错）。